四逆散与四逆汤的里均含有的药物是
A. 茯苓
B. 附子
C. 白术
D. 甘草
E. 人参

正确答案：D。甘草

解析：四逆汤组成为附子、干姜、甘草（四逆汤中附草姜，阳衰寒厥急煎尝，腹痛吐泻脉沉细，急投此方可回阳）；四逆散组成为柴胡、芍药、枳实、甘草（四逆散里用柴胡，芍药枳实甘草须，此是阳郁成厥逆，疏肝理脾奏效齐）（D对）。